屈肌反射和腱反射
A. 感受器相同
B. 引起反射的刺激的性质相同
C. 前者的效应器为屈肌，后者主要为伸肌
D. 都是短暂的反射活动
E. 都能引起肢体的位相性运动

正确答案：D。都是短暂的反射活动